关于汤剂的叙述中，错误的为
A. 以水为溶剂
B. 吸收较快
C. 能适应中医辨证施治，随症加减
D. 煎后浓缩加防腐剂服用
E. 制法简单易行

正确答案：D。煎后浓缩加防腐剂服用

解析：本题考查的是汤剂的特点。汤剂临用时制备（D错，为本题正确答案）。汤剂的特点：汤剂是将中药饮片或粗粒加水煎煮或沸水浸泡、去渣取汁而成的液体制剂。汤剂主要供内服，也可供含漱、洗浴、熏蒸之用。汤剂是临床应用最早、最为广泛的传统剂型之一，汤剂组方灵活，可随症加减用药，适应中医辨证施治的需要（C对）；水为溶剂（A对），价廉易得，制法简便（E对），奏效迅速（B对）；但汤剂临用时制备，味苦量大，服用不便，不宜久置；挥发性及难溶性成分提取率或保留率低，可能影响疗效。